缺氧性呼吸衰竭，血气分析特点是
A. PaO₂＜50mmHg，PaCO₂降低
B. PaO₂＜60mmHg，PaCO₂升高
C. PaO₂＜60mmHg，PaCO₂降低
D. PaO₂＜60mmHg，同时伴有PaCO₂＞50mmHg
E. PaO₂＜60mmHg，同时伴有PaCO₂＞60mmHg

正确答案：C。PaO₂＜60mmHg，PaCO₂降低

解析：Ⅰ型呼吸衰竭即缺氧性呼吸衰竭，血气分析特点是PaO₂＜60mmHg，PaCO₂降低或正常。主要见于肺换气障碍（通气/血流比例失调、弥散功能损害和肺动-静脉分流）疾病，如严重肺部感染性疾病、间质性肺疾病、急性肺栓塞等。掌握“呼吸衰竭”知识点。